患者多年前曾用过心得安，现到药店购买此药，药师应提供的药品是
A. 普萘洛尔
B. 硝苯地平
C. 硝酸异山梨酯
D. 维拉帕米
E. 美西律

正确答案：A。普萘洛尔

解析：本题考查药品的别名。药师应提供的药品是普萘洛尔（A对）。普萘洛尔别名“心得安”。硝苯地平（B错）别名“心痛定”。硝酸异山梨酯（C错）别名“消心痛”。维拉帕米（D错）别名“异博定”。美西律（E错）别名“慢心律”。